患儿，6岁。发病2周，全身浮肿，尿少，头晕，头痛，恶心呕吐，口中臭秽，甚至昏迷，舌苔腻，脉滑数。治疗应首选
A. 羚角钩藤汤
B. 龙胆泻肝汤
C. 己椒苈黄丸合参附汤
D. 温胆汤合附子泻心汤
E. 真武汤

正确答案：D。温胆汤合附子泻心汤

解析：题中患儿以全身浮肿，尿少为主症，故诊断为水肿，属西医急性肾小球肾炎。全身浮肿，尿少，头晕，头痛，恶心呕吐，口中气秽，甚至昏迷为浊邪壅滞三焦，气机升降失常，肾主水液功能丧失，水毒內闭，中焦格拒所致，故辨为水毒內闭证，治宜通腑泄浊，解毒利尿。龙胆泻肝汤合羚角钩藤汤能平肝泻火，清心利水，为治疗小儿急性肾小球肾炎邪陷心肝证的选方（AB错）。己椒苈黄丸合参附汤能泻肺逐水，温阳扶正，为小儿急性肾小球肾炎水凌心肺证的选方（C错）。温胆汤合附子泻心汤能通腑泄浊，解毒利尿，为小儿急性肾小球肾炎水毒內闭证的选方（D对）。真武汤功能温阳利水，主治阳虚水泛证（E错）。